下列中哪项是错误的叙述
A. 条件是指在疾病原因的作用下，对疾病发生和发展有影响的因素
B. 条件包括自然条件和社会条件
C. 对某一疾病是条件的因素，可能是另一疾病的原因
D. 条件对于疾病是必不可少的
E. 条件可促进或延缓疾病的发生

正确答案：D。条件对于疾病是必不可少的

解析：疾病发生的条件是指能促进或减缓疾病发生的某种机体状态或自然环境或社会因素，条件本身不引起疾病，但可影响病因对机体的作用，所以条件对于疾病并不是必不可少的（D错，为本题正确答案）。